化学毒物在体内生物转化的最主要器官是
A. 肝
B. 肾
C. 肺
D. 小肠

正确答案：A。肝

解析：本题考查化学毒物在体内生物转化的最主要器官。化学毒物在体内生物转化的最主要器官是肝（A对BCD错）。